患者，男性，58岁，患高血压性心脏病数年，有时因微动或过劳而发生心绞痛，最初经休息后尚可自行缓解，几天之后心绞痛加重并有心律失常，此时合理的治疗方案是
A. 硝酸甘油+硝酸异山梨酯
B. 普萘洛尔+维拉帕米
C. 地尔硫䓬+普萘洛尔
D. 硝酸甘油+普萘洛尔
E. 地尔硫䓬+维拉帕米

正确答案：D。硝酸甘油+普萘洛尔